炔雌醇的化学性质有
A. 可溶于氢氧化钠水溶液
B. 可与异烟肼反应生成异烟腙
C. 可与碱性酒石酸铜反应生成橙红色沉淀
D. 可与硝酸银试液反应生成白色沉淀
E. 在吡啶中呈左旋

正确答案：A、D、E。可溶于氢氧化钠水溶液；可与硝酸银试液反应生成白色沉淀；在吡啶中呈左旋